牙周手术时，与缺牙间隙相邻处的龈瓣缝合，应采用的缝合方法
A. 牙间间断缝合
B. 间断缝合
C. 悬吊缝合
D. 锚式缝合
E. 褥式缝合

正确答案：D。锚式缝合

解析：锚式缝合：是将最后一个磨牙远中的龈瓣或缺牙隙处的龈瓣以锚样的方式固定在邻近的牙上。适用于最后一个磨牙远中楔形瓣的缝合，或与缺牙间隙相邻处的龈瓣闭合。注意进针处应尽量靠近牙齿，以使龈瓣紧贴牙面，避免愈合后在牙齿邻面的牙龈形成V形缺口。掌握“慢性牙周炎的治疗原则、程序及方法”知识点。